《麻醉药品和精神药品管理条例》规定，区域性批发企业之间因特殊情况需要调剂麻醉药品和第一类精神药品的，应在调剂后2日内分别报备案的部门是
A. 县级药品监督管理部门
B. 设区的市级药品监督管理部门
C. 省、自治区、直辖市人民政府药品监督管理部门
D. 国务院药品监督管理部门
E. 国务院卫生行政部门

正确答案：C。省、自治区、直辖市人民政府药品监督管理部门

解析：本题考查麻醉药品和精神药品销售渠道管理。《麻醉药品和精神药品管理条例》规定，区域性批发企业之间因特殊情况需要调剂麻醉药品和第一类精神药品的，应在调剂后2日内分别报备案的部门是省、自治区、直辖市人民政府药品监督管理部门（C对）。麻醉药品和精神药品销售渠道管理：（1）全国性批发企业在确保责任区内区域性批发企业供药的基础上，可以在全国范围内向其他区域性批发企业销售麻醉药品和第一类精神药品。（2）全国性批发企业向取得麻醉药品和第一类精神药品使用资格的医疗机构销售麻醉药品和第一类精神药品，须经医疗机构所在地省（区、市）药品监督管理部门批准。（3）区域性批发企业在确保责任区内医疗机构供药的基础上，可以在本省行政区域内向其他医疗机构销售麻醉药品和第一类精神药品。（4）由于特殊地理位置的原因，区域性批发企业需要就近向其他省、自治区、直辖市行政区域内取得麻醉药品和第一类精神药品使用资格的医疗机构销售麻醉药品和第一类精神药品的，应当经企业所在地省（区、市）药品监督管理部门批准。（5）区域性批发企业之间因医疗急需、运输困难等特殊情况需要调剂麻醉药品和第一类精神药品的，应当在调剂后2日内将调剂情况分别报所在地省（区、市）药品监督管理部门备案。（6）从事第二类精神药品批发业务的企业，可以将第二类精神药品销售给定点生产企业、具有第二类精神药品经营资格的药品批发企业、医疗机构、从事第二类精神药品零售的药品零售连锁企业。